注射破伤风抗毒素（TAT）的目的是
A. 对易感人群进行预防接种
B. 杀灭伤口中繁殖的破伤风梭菌
C. 对可疑或确诊的破伤风患者进行紧急预防或治疗
D. 主要用于儿童的预防接种
E. 中和与神经细胞结合的毒素

正确答案：C。对可疑或确诊的破伤风患者进行紧急预防或治疗

解析：抗毒素是机体产生特异性针对毒素的抗体，能阻断外毒素与靶细胞上特异性受体结合，使毒素失去毒性作用（E错）。破伤风免疫属外毒素免疫，主要是抗毒素发挥作用，因此获得有效抗毒素的途径就是进行人工免疫，即对于可疑或者确诊发病患者应早期、足量使用TAT，做紧急预防以及特异性治疗（C对）。对易感人群，儿童等进行基础免疫时，注射的是破伤风类毒素（AD错）。破伤风抗毒素主要作用是使毒素失去毒性作用，而非杀死破伤风梭菌（B错）。